患儿，女，5岁。反复咳嗽2个月，咳嗽呈发作性，干咳痰少，夜间加剧，用抗生素治疗无效，口服氨茶碱能明显减轻症状。应首先考虑的是
A. 寒性哮喘
B. 热性哮喘
C. 急性上呼吸道感染
D. 咳嗽变异性哮喘
E. 急性支气管炎

正确答案：D。咳嗽变异性哮喘

解析：咳嗽变异性哮喘诊断标准：①咳嗽持续>4周，常在夜间和（或）清晨发作，以干咳为主；②临床上无感染征象，或经较长期抗生素治疗无效；③抗哮喘药物诊断性治疗有效；④排出其他原因引起的慢性咳嗽⑤支气管激发试验阳性和（或）FEP每日变异率（连续监测1～2周）≥20%；⑥个人或一、二级亲属特应性疾病史，或变应原检测阳性。以上①～④项为诊断基本条件。本病例临床特点符合①～③项，故应首先考虑咳嗽变异性哮喘（D对）。寒性哮喘（A错）临床以咳喘哮鸣，痰白清稀，形寒无汗为特征。热性哮喘（B错）临床以咳喘哮鸣，痰稠色黄，面赤口渴。急性上呼吸道感染（C错）是指各种病原体侵犯喉部以上呼吸道的鼻、鼻咽和咽部的急性感染，相当于中医的“感冒”，临床以发热、鼻塞、流涕、咽痛或不适为主要症状。急性支气管炎（E错）支气管黏膜的急性炎症，常累及气管，临床以咳嗽、咳痰为主要症状。